男，28岁，看见或听到“和平”二字时，马上想起“战争”；看见或听到“安全”二字时，便想到“危险”二字，此症状是
A. 强迫性穷思竭虑
B. 超价观念
C. 强迫性联想
D. 强迫意向
E. 牵连观念

正确答案：C。强迫性联想

解析：男性青年患者，看见或听到“和平”二字时，马上想起“战争”；看见或听到“安全”二字时，便想到“危险”二字（强迫性联想的典型表现）。强迫性联想（C对）是指患者脑中出现一个观念或看到一句话，便会联想起另一个观念或词句，而大多是对立性质的，如想起“和平”马上就可以联想到“战争”等。强迫性穷思竭虑（A错）是指患者对一些常见的事情、概念或现象反复思考，刨根究底，自知毫无现实意义，但又控制不住自己。超价观念（B错）是一种在意识中占主导地位的错误观念。这种观念往往是是片面的，与实际情况有出入，常明显地影响到患者的行为。如当别人在宿舍丢了东西，因某人在这之前回过宿舍，于是他觉得别人在议论他。强迫意向（D错）是指患者体会到一种强烈的内在冲动要去做某种违背自己意愿的事情，但一般不会转变为行动。如看到异性就想拥抱等。牵连观念（E错）是指将无关的外界现象解释为与本人有关，而且往往是恶意的，如当看到有人嘀咕，就会感觉他们在说自己的坏话，有人偷偷地笑就认为是在笑自己。